主要作用于髓袢升支粗段皮质部和髓质部的是
A. 呋塞米
B. 螺内酯
C. 氢氯噻嗪
D. 氨苯蝶啶
E. 甘露醇

正确答案：A。呋塞米

解析：呋塞米（A对）作用于髓袢升支粗段皮质部和髓质部，特异性抑制髓袢升支管腔膜侧的Na⁺-K⁺-2Cl⁻同向转运子，抑制NaCl的重吸收。螺内酯是醛固酮受体拮抗剂，作用于远曲小管和集合管，阻断Na⁺-K⁺和Na⁺-H⁺交换，结果Na⁺、Cl⁻和水排泄增多而发挥利尿作用（B错）。氢氯噻嗪（C错）主要抑制远端小管前段和近端小管（作用较轻）对氯化钠的重吸收，从而增加远端小管和集合管的Na⁺-K⁺交换，K⁺分泌增多而发挥利尿作用。氨苯蝶啶（D错）是直接抑制肾脏远曲小管和集合管的Na⁺进入上皮细胞，进而改变跨膜电位，而减少K⁺的分泌；Na⁺的重吸收减少，从而使Na⁺、Cl⁻及水排泄增多而发挥利尿作用。甘露醇（E错）进入体内后能提高血浆渗透压，从肾小球滤过后，不易被肾小球重吸收，使尿渗透压增高，带出大量水分而发挥利尿作用。